由于肺气肿患者大多数都同时伴有咳嗽、咳痰病史，很难与慢性支气管炎的界限绝对分开，因此，临床上将他们统称为
A. 慢性支气管炎
B. 慢性肺源性心脏病
C. 慢性支气管哮喘
D. 慢性呼吸衰竭
E. 慢性阻塞性肺疾病

正确答案：E。慢性阻塞性肺疾病

解析：由于肺气肿患者大多数同时伴有咳嗽、咳痰病史，很难与慢性支气管炎的界限绝对分开，因此，临床上将他们统称为慢性阻塞性肺疾病（简称慢阻肺或COPD）。掌握“慢性阻塞性肺疾病”知识点。